最易引起电解质紊乱的药物是
A. 氢氯噻嗪
B. 螺内酯
C. 呋塞米
D. 氨苯蝶啶
E. 乙酰唑胺

正确答案：C。呋塞米

解析：袢利尿药（呋塞米）了引起水与电解质紊乱：常为过度利尿所引起，表现为低血容量、低血钾、低血钠、低氯性碱血症，长期应用还可引起低血镁。掌握“袢利尿药及噻嗪类”知识点。